各种补体成分浓度达到成人水平的年龄是
A. 2月
B. 3月
C. 4月
D. 5月
E. 6月

正确答案：E。6月

解析：胎儿出生时免疫器官和免疫细胞均已相当成熟，免疫功能低下可能为未接触抗原、尚未建立免疫记忆。其中母体的补体不转输给胎儿，新生儿补体经典途径成分活性是其母亲的50%-60%，生后3-6个月（E对）达到成人水平。